执业药师在履行与执业活动有关的职责中，依法签署有关药学业务文件的道德行为规范要求是
A. 不得作或认可虚假的陈述
B. 按规定保存有效处方
C. 制定安全、有效、合理的用药方案
D. 接受行业协会等自律性组织的约束
E. 参与制定、修订相关法律、法规文件

正确答案：D。接受行业协会等自律性组织的约束